成人内服朱砂的一日量是
A. 0.1～0.5g
B. 0.6～1g
C. l～3g
D. 3～6g
E. 6～9g

正确答案：A。0.1～0.5g

解析：本题考查的是朱砂的用法用量。成人内服朱砂的一日量是0.1～0.5g（A对）。朱砂：【用法用量】内服：研末冲，或入丸散，0.1～0.5g；不入煎剂。外用：适量，干掺，或调敷，或喷喉。天竺黄：【用法用量】内服：煎汤，3～9g；研末吞服，每次0.6～1g（B错）；或入丸剂。细辛：【用法用量】内服：煎汤，1～3g（C错）；粉末，0.5～1g。外用：适量，研末吹鼻、塞耳、敷脐，或调涂。亦可煎汤含漱。升麻：【用法用量】内服：煎汤，用于升阳，3～6g（D错），宜蜜炙；用于发表透疹、清热解毒，可用至15g，宜生用；或入丸散。外用：适量，生用研末调涂，煎汤含漱，或淋洗。槐花：【用法用量】内服：煎汤，6～9g（E错）；或入丸散。止血宜炒炭用，泻火宜生用。